某疟疾病患者突然出现昏迷，给予二盐酸奎宁静滴抢救，抢救过程中，病人又出现寒战，高热，血红蛋白尿，应改下列哪种药继续抢救
A. 氯喹
B. 甲氟喹
C. 伯氨喹
D. 乙胺嘧啶
E. 青蒿素

正确答案：E。青蒿素